男，38岁。会阴部不适，双侧睾丸疼痛1年。社区医院按“前列腺炎”治疗效果不明显。近期症状加重，出现血精。查体：睾丸正常，左侧附睾尾部肿大，质地偏硬，左输精管增粗，呈“串珠状”改变。直肠指检前列腺略大，有大小不等的结节，无压痛。为协助诊断，需补充的最重要的病史是
A. 不洁性生活史
B. 泌尿系感染史
C. 附睾炎病史
D. 睾丸炎病史
E. 结核病史

正确答案：E。结核病史

解析：青年男性患者，会阴部不适，双侧睾丸疼痛，按“前列腺炎”治疗效果不明显，近期症状加重，出现血精（提示可能有前列腺、精囊结核），查体睾丸正常，左侧附睾尾部肿大、质地偏硬（提示可能有附睾结核），左输精管增粗，呈“串珠状”改变（输精管结核典型表现），直肠指检前列腺略大，有大小不等的结节，无压痛（提示可能有前列腺结核），结合患者病史、症状和及相关检查，最可能的诊断为生殖系结核。男性生殖系统结核大多数继发于肾结核，一般来自后尿道感染，少数由血行直接播散所致，故为协助诊断，需了解泌尿系统有无结核病变，故需补充的最重要病史是结核病史（E对）。不洁性生活史（A错）对淋病、梅毒等性传播疾病的诊断具有重要意义。泌尿系感染史（B错）、附睾炎病史（C错）、睾丸炎病史（D错）一般指非特异性感染，结核属特异性感染，故对其诊断价值不大。